属于健康促进教育工作的是
A. 厂矿新工人就业前体检
B. 给工人宣讲粉尘的危害和防护
C. 新建厂矿职业卫生设施的评价与验收
D. 制定某化学物的卫生限值
E. 某化学物质的毒理学试验

正确答案：B。给工人宣讲粉尘的危害和防护